主宰精神活动的脏是
A. 心
B. 肺
C. 脾
D. 肝
E. 肾

正确答案：A。心

解析：本题考查的是五脏的生理功能。主宰精神活动的脏是心（A对）。五脏，指心、肺、脾、肝、肾。五脏的生理功能是：（一）心的生理功能主要有两方面：一是主血脉，二是主神明。1.心主血脉：（1）心有推动血液在脉管内运行的作用。（2）心对血液的生成也有一定的作用。2.心主神明：心主神明，又称心藏神，即心有主宰生命活动和主宰意识、思维、情志等精神活动的功能。（二）肺（B错）的生理功能，包括肺主气、司呼吸，主宣发肃降，通调水道，朝百脉而主治节。1.肺主气，司呼吸：（1）肺主呼吸之气。（2）肺主一身之气。2.肺主宣发与肃降：肺主宣发，指肺气具有向上、向外、升宣、发散的生理功能。肺主肃降，是指肺气具有向下、向内、肃降、收敛的生理功能。3.肺主通调水道：肺通调水道的功能，是指肺气宣发和肃降对于体内津液代谢具有疏通和调节的作用。4.肺朝百脉，主治节：肺朝百脉，是指全身的血液，都通过经脉而会聚于肺，通过肺的呼吸，进行气体的交换，然后再输布到全身。肺主治节，指肺具有治理调节呼吸及全身之气、血、津液的功能。（三）脾（C错）的生理功能主要有两方面：一是主运化，二是主统血。1.脾主运化：（1）运化水谷精微，是指脾对饮食物的消化和水谷精微的吸收、转输、布散的作用。（2）运化水液，是指脾对水液的吸收、转输和布散作用。2.脾主统血：脾主统血，是指脾能统摄、控制血液，使之正常地循行于脉内，而不逸出于脉外。（四）肝（D错）主要有两方面：一是主疏泄，二是藏血。1.肝主疏泄：肝主疏泄，是指肝气具有疏通、畅达全身气机，进而调畅精血津液的运行输布、脾胃之气的升降、胆汁的分泌排泄以及情志活动等作用。肝的疏泄功能反映了肝为刚脏、主升、主动的生理特点，中心环节是调畅全身气机。肝主疏泄，调畅全身气机功能，具体体现在五个方面：（1）调畅情志。（2）协调脾胃升降。（3）促进胆汁生成与排泄。（4）促进血液运行和津液代谢。（5）调畅排精行经。2.肝主藏血：肝藏血，是指肝具有贮藏血液、调节血量和防止出血的功能。（1）贮藏血液。（2）调节血量。（3）防止出血。（五）肾（E错）主要有三方面：一是藏精，主生长、发育与生殖；二是主水；三是主纳气。1.肾藏精，主生长、发育与生殖：肾藏精，是指肾对精气具有封藏作用。（1）肾主生长、发育。（2）肾主生殖。（3）肾中阴阳为各脏阴阳之根本。2.肾主水：肾主水，是指肾的气化功能，对于体内津液的输布和排泄，维持津液代谢平衡，起着极为重要的调节作用。（1）主宰全身水液代谢。（2）生成尿液。3.肾主纳气：肾主纳气，是指肾有摄纳肺所吸入的清气，保持吸气的深度，防止呼吸表浅的作用。